腘窝上外侧缘损伤可能累及哪支神经
A. 坐骨神经
B. 闭孔神经
C. 胫神经
D. 腓总神经
E. 股神经

正确答案：D。腓总神经

解析：腓总神经（D对）在腘窝近侧端由坐骨神经发出后，沿构成腘窝上外侧界的股二头肌肌腱内侧向外下走行，所以腘窝上外侧缘损伤可能累及腓总神经。